正确描述后交叉韧带的是
A. 在伸膝时紧张
B. 在屈膝时松弛
C. 限制胫骨向后移动
D. 限制胫骨旋外
E. 跗于股骨外侧髁的内侧面

正确答案：C。限制胫骨向后移动

解析：后交叉韧带起自胫骨髁间隆起的后方，附着于股骨内侧髁的外侧面（E错），在屈膝时最紧张（AB错），可限制胫骨向后移动（C对D错）。